病人认真讲了一番话，但周围的医生们都不理解他要说什么问题，该症状为
A. 思维被夺取
B. 思维被洞悉
C. 思维贫乏
D. 思维散漫
E. 思维迟缓

正确答案：D。思维散漫

解析：该患者认真讲了一番话，但周围的医生们都不理解他所要阐述的主题思想是什么为思维散漫（D对）。思维被夺属于思维联想障碍，感到自己思想被某种外力突然抽走（A错）。思维被洞悉妄想又称内心揭露感，患者感到内心所想的事情，虽然没有说出，也没有用文字书写出来，但被别人都知道了（B错）。思维贫乏的患者感到脑子空空荡荡，没什么思想（C错）。思维迟缓的患者感到脑子就像生了锈的机器，变笨了反应变慢了（E错）。